正确描述膝关节的是
A. 是人体最大、最复杂的关节
B. 关节面由股骨下端和胫骨上端构成
C. 关节囊包裹着髌骨
D. 滑膜层包裹着关节腔内的所有结构
E. 属屈戌关节，只能作屈、伸运动

正确答案：A。是人体最大、最复杂的关节

解析：膝关节是人体最大最复杂的关节（A对），是单轴关节,属屈戌关节,主要做屈伸运动，但是在半屈膝位可以做少许旋内和旋外运动（E错），它是由髌骨与股骨的髌面相接，股骨的内、外侧髁分别与胫骨的内、外侧髁相接，并非是由股骨下端和胫骨上端组成关节面（B错），髌股不在膝关节关节囊内（C错）。膝关节滑膜层覆盖关节内除了关节软骨和半月板以外（D错）的所有结构。